与非解剖式牙比较，解剖式牙在正中（牙合）时
A. 上下颌牙的尖窝锁结关系差，侧向力小，功能较强
B. 上下颌牙的尖窝锁结关系差，侧向力小，功能较弱
C. 上下颌牙的尖窝锁结关系差，侧向力大，功能较强
D. 上下颌牙的尖窝锁结关系好，侧向力小，功能较强
E. 上下颌牙的尖窝锁结关系好，侧向力大，功能较强

正确答案：E。上下颌牙的尖窝锁结关系好，侧向力大，功能较强

解析：解剖式牙：（牙合）面形态与正常牙相似，牙尖斜度约30°。半解剖式牙：牙尖斜度低于正常，约20°。非解剖式牙：（牙合）面形态与天然牙有别，或者为无尖牙，或者为舌尖咬合类型等。与非解剖式牙比较，解剖式牙在正中（牙合）时：上下颌牙的尖窝锁结关系好，侧向力大，功能较强。掌握“局部义齿人工牙及基托”知识点。